关于输精管与输尿管的关系，正确的是
A. 输精管自下而上越其前方
B. 输精管自外向内越其前方
C. 输精管自上而下越其后方
D. 输精管自外向内越其后方
E. 输精管自上而下越其前方

正确答案：E。输精管自上而下越其前方

解析：输精管自上而下跨过输尿管末端前内方（E对）至膀胱底的后面和直肠前面。